关于受体的概念哪项是正确的
A. 与配体结合无饱合性
B. 与配体结合不可逆性
C. 结合配体的结构多样性
D. 是位于细胞核上的基因片断
E. 均有相应的内源性配体

正确答案：E。均有相应的内源性配体